可能导致血糖升高的药品是
A. 阿司匹林
B. 加替沙星
C. 劳拉西泮
D. 西洛他唑
E. 伪麻黄碱

正确答案：B。加替沙星

解析：本题考查加替沙星的不良反应。加替沙星（B对）可使胰岛细胞空泡化，导致胰岛素水平降低，血糖升高。阿司匹林（A错）不良反应为胃肠道反应及血压升高。劳拉西泮（C错）、西洛他唑（D错）可能导致低血压。伪麻黄碱（E错）可能导致血压升高。